急性心包炎心包积液时最突出的症状是
A. 心前区疼痛
B. 发热
C. 呼吸困难
D. 声音嘶哑
E. 吞咽困难

正确答案：C。呼吸困难

解析：急性心包炎心包积液时，导致双肺受压，影响正常呼吸功能，因此呼吸困难（C对）是心包积液时最突出的症状。急性心包炎心包积液时，心前区疼痛（A错）、发热（B错）、声音嘶哑（D错）和吞咽困难（E错）等症状均可出现，但都不是急性心包炎心包积液时最突出的症状。